外感风寒湿邪，症见恶寒发热，无汗，头痛项强，肢体酸楚疼痛，口苦而渴者，治宜选用
A. 麻黄汤
B. 荆防败毒散
C. 九味羌活汤
D. 藿香正气散
E. 羌活胜湿汤

正确答案：C。九味羌活汤

解析：外感风寒湿邪，则郁遏卫阳，闭塞腠理，阻滞经络，气血运行不畅，故可见恶寒发热，无汗，头痛项强，肢体酸楚疼痛；口苦而渴，则提示有内热，故此为外感风寒湿邪，内有蕴热证，九味羌活汤可发汗祛湿，兼清里热（C对）。麻黄汤的功用为发汗解表，宣肺平喘，主治外感风寒表实证（A错）。荆防败毒散的功用为发汗解表，消疮止痛，主治疮肿初起（B错）。藿香正气散的功用为解表化湿，理气和中，主治外感风寒，内伤湿滞证（D错）。羌活胜湿汤的功用为祛风，胜湿，止痛，主治风湿在表之痹证（E错）。